男性，21岁。近半年来反复心悸胸痛劳力性呼吸困难。时有头晕或短暂神志丧失。体检发现：心脏轻度增大，心尖部有2级收缩期杂音和第四心音，胸骨左缘第3～4肋间闻及较粗糙的喷射性收缩期杂音。最有价值的诊断方法是
A. 胸部X线摄片
B. 心电图
C. 超声心动图
D. 心脏核素检查
E. 冠状动脉造影

正确答案：C。超声心动图

解析：患者青年男性，反复心悸、胸痛、劳力性呼吸困难，时有头晕或短暂神志丧失，体检发现：心脏轻度增大，心尖部有2级收缩期杂音和第四心音，胸骨左缘第3～4肋间闻及较粗糙的喷射性收缩期杂音（提示流出道梗阻），考虑诊断为肥厚型梗阻性心肌病。对肥厚型梗阻性心肌病患者最有价值的诊断方法是超声心动图（C对）。其特征性改变为心室不对称肥厚而无心室腔增大，舒张期室间隔厚度达15mm或与后壁厚度之比≥1.3等。胸部X线摄片（A错）仅可见心影大小正常或左心室增大，而心电图（B错）主要用于心律失常的诊断，两者都缺乏特异性改变。心脏核素检查（D错）主要用于判断心肌梗死后心肌的活性。冠状动脉造影（E错）主要用于冠心病的确诊，肥厚型梗阻性心肌病患者多无异常，仅可用于鉴别诊断。